具有脉位表浅特点的脉象是
A. 洪脉、革脉、濡脉
B. 芤脉、弱脉、虚脉
C. 洪脉、革脉、弱脉
D. 洪脉、濡脉、牢脉
E. 弱脉、伏脉、牢脉

正确答案：A。洪脉、革脉、濡脉

解析：洪脉、革脉、濡脉均有脉位表浅的特点（A对）。芤脉的脉象特征是浮大而软，但是弱脉、虚脉均有脉位下沉的特点（B错）。弱脉、濡脉均有脉位下沉的特点（CDE错）。